呈类椭圆形的厚片，外表皮灰棕色，切面皮部红棕色，有数处向内嵌入木部，木部黄白色，有多数导管孔，射线呈放射状排列的饮片是
A. 木通
B. 槲寄生
C. 大血藤
D. 鸡血藤
E. 桑寄生

正确答案：C。大血藤

解析：本题考查的是大血藤饮片的性状鉴别。呈类椭圆形的厚片，外表皮灰棕色，切面皮部红棕色，有数处向内嵌入木部，木部黄白色，有多数导管孔，射线呈放射状排列的饮片是大血藤（C对）。大血藤：【性状鉴别】饮片呈类椭圆形的厚片。外表皮灰棕色、粗糙。切面皮部红棕色，有数处向内嵌入木部，木部黄白色，有多数导管孔，射线呈放射状排列。气微，味微涩。木通（A错）：【性状鉴别】饮片呈圆形、椭圆形或不规则形片。外表皮灰棕色或灰褐色。切面射线呈放射状排列，髓小或有时中空。气微，味微苦而涩。槲寄生（B错）：【性状鉴别】饮片为不规则的厚片。茎外皮黄绿色、黄棕色或棕褐色。切面皮部黄色，木部浅黄色，有放射状纹理，髓部常偏向一边。叶片黄绿色或黄棕色，全缘，有细皱纹；革质。气微，味微苦，嚼之有黏性。鸡血藤（D错）：【性状鉴别】药材呈椭圆形、长矩圆形或不规则的斜切片。栓皮灰棕色，有的可见灰白色斑块，栓皮脱落处显红棕色。质坚硬。切面木部红棕色或棕色，导管孔多数；韧皮部有树脂状分泌物呈红棕色至黑棕色，与木部相间排列呈数个同心性椭圆形环或偏心性半圆形环；髓部偏向一侧。气微，味涩。桑寄生（E错）：【性状鉴别】饮片为厚片或不规则短段。外表皮红褐色或灰褐色，具细纵纹，并有多数细小突起的棕色皮孔，嫩枝有的可见棕褐色茸毛。切面皮部红棕色，木部色较浅。叶多卷曲或破碎，完整者展平后呈卵形或椭圆形，表面黄褐色，幼叶被细茸毛，先端钝圆，基部圆形或宽楔形，全缘；革质。气微，味涩。